引起SSPE的病原体是
A. 风疹病毒
B. 麻疹病毒
C. 轮状病毒
D. 腮腺炎病毒
E. 流感病毒

正确答案：B。麻疹病毒

解析：亚急性硬化性全脑炎（简称SSPE）是由属于副粘病毒科麻疹病毒属的麻疹病毒引起的急性感染的迟发并发症。而风疹病毒是风疹的病原体。轮状病毒属于呼肠病毒科，是人类、哺乳动物和鸟类腹泻的重要病原体。腮腺炎病毒属于副粘病毒科，主要引起流行性腮腺炎。流感病毒主要引起流感。掌握“正、副黏病毒”知识点。